IgG转移进入胎儿血液循环，是通过胎盘的下列哪一段
A. Fab段
B. CH2区
C. Fc
D. Fd
E. 绞链区

正确答案：C。Fc

解析：IgG可通过胎盘滋养层细胞表达的新生Fc段受体（FcRn）转移进入胎儿血液循环，赋予新生儿抗感染免疫力。掌握“免疫球蛋白的类型及功能”知识点。